在西班牙召开的2000年世界生命伦理学大会上由国际生命伦理学会科学委员会通过的宣言是
A. 《东京宣言》
B. 《迈蒙尼提斯祷文》
C. 《苏联医生宣言》
D. 《吉汉宣言》
E. 《夏威夷宣言》

正确答案：D。《吉汉宣言》

解析：《吉汉宣言》提出国际生命伦理学会科学委员会坚决主张科技必须考虑公共利益（D对）。1975年10月，在东京召开的第二十九届世界医学大会上，通过了《东京宣言》，规定《关于对拘留犯和囚犯给予折磨、虐待、非人道的对待和惩罚时，医师的行为准则》（A错）。《迈蒙尼提斯祷文》说道：“启我爱医术，复爱世间人，愿绝名利心，尽力为病人”（B错）。1971年苏联最高苏维埃通过了《苏联医师宣言》，要求每一名医学毕业生要进行宣誓（C错）。1977年，在夏威夷召开的第六届世界精神病学大会，通过了关于精神病医生道德原则的《夏威夷宣言》（E错）。